伤寒患者在病程第2～3周体温逐渐下降，尚未达到正常温度，体温又再次升高，持续5～7天后才正常，血培养阳性。其诊断是
A. 伤寒复发
B. 伤寒再燃
C. 并发肠出血
D. 并发肠穿孔
E. 中毒性肝炎

正确答案：B。伤寒再燃

解析：本例伤寒患者在病程第2～3周体温逐渐下降，尚未达到正常温度，体温又再次升高，持续5～7天后才正常，血培养阳性，提示伤寒再燃（B对），指部分伤寒患者在缓解期，体温还未下降到正常，即再度升高，持续5～7天后退热，血培养也常阳性。其发生机理与复发相同，即与伤寒杆菌菌血症尚未得到完全控制有关。有效和足量的抗菌药物治疗可减少或杜绝再燃。伤寒复发（A错）是指患者在退热1～3周后，体温再度升高，临床症状再次出现，血培养阳性，称为复发，多见于抗菌治疗不彻底的患者，病灶内的伤寒杆菌没有完全清除，潜伏在单核-巨噬细胞系统中的细菌大量繁殖，再次侵入血流所致。复发者病情多较轻，病程短，并发症少。个别患者可复发多次。肠出血（C错）为伤寒常见的严重并发症。多见于病程的第2～3周。少量出血可仅有大便潜血阳性，患者无症状或仅见头晕，心率增快等；大量出血时，大便为暗红色，患者表现为体温骤降，脉细速，头晕，面色苍白，烦躁，冷汗，血压下降等休克征象。肠穿孔（D错）是最严重的并发症，多见于病程的第2～3周，常发生在回肠末端，成人多见。穿孔前可有腹胀、腹泻或肠出血等前兆。穿孔时突然右下腹剧痛，有明显腹膜炎体征，伴有恶心，呕吐，四肢冰冷，脉搏细速，呼吸急促，体温与血压下降等休克表现（休克期）。经1～2小时后腹痛及其他症状暂时缓解（平静期）。不久体温又迅速升高，腹痛持续存在并加剧；腹壁紧张，有广泛压痛及反跳痛，肝浊音界缩小或消失，肠鸣音减弱或消失，腹腔内出现游离液体；X线检查膈下有游离气体，白细胞数较前增高伴核左移（腹膜炎期）。中毒性肝炎（E错）又称伤寒肝炎，多见于病程第1～3周。主要表现为肝脏肿大，可伴有压痛，少数患者出现轻度黄疸，谷丙转氨酶轻至中度升高。随着病情好转，肝肿大及肝功能可于2～3周恢复正常，发生肝功能衰竭者少见，仅个别病例可因深度黄疸并发肝性脑病而危及生命。